下列药物中，适宜在餐前服用的是
A. 头孢呋辛酯片
B. 莫沙必利片
C. 双氯芬酸钠片
D. 伊马替尼片
E. 双歧杆菌三联活菌胶囊

正确答案：B。莫沙必利片

解析：本题考查莫沙必利片。适宜在餐前服用的是莫沙必利片（B对）。莫沙必利属于促胃动力药，餐前服用帮助消化。头孢呋辛酯片（A错）应于餐后服用。双氯芬酸钠片（C错）属于非甾体抗炎药，餐后服用能减少对胃肠道的刺激。伊马替尼片（D错）应在进餐时服用，并饮一大杯水。双歧杆菌三联活菌胶囊（E错）饭后30分钟用温开水送服。